下列不属于特殊使用级抗菌药物使用情形的是
A. 具有明显或者严重不良反应，不宜随意使用的抗菌药物
B. 需要严格控制使用，避免细菌过快产生耐药的抗菌药物
C. 疗效、安全性方面的临床资料较少的抗菌药物
D. 价格昂贵的抗菌药物
E. 在危重病人抢救中使用的抗菌药物

正确答案：E。在危重病人抢救中使用的抗菌药物

解析：特殊使用级抗菌药物是指具有以下情形之一的抗菌药物：①具有明显或者严重不良反应，不宜随意使用的抗菌药物；②需要严格控制使用，避免细菌过快产生耐药的抗菌药物；③疗效、安全性方面的临床资料较少的抗菌药物；④价格昂贵的抗菌药物。掌握“抗菌药物临床应用概述及管理”知识点。